环境流行病学的研究必须考虑哪种情况
A. 已知暴露因素，研究健康效应
B. 已知人群中健康已出现异常，寻找病因
C. 因果均已清楚，研究剂量-反应关系
D. 研究剂量-效应关系
E. 已知暴露因素，研究解决方案

正确答案：C。因果均已清楚，研究剂量-反应关系

解析：本题考查环境流行病学研究的内容。环境流行病学是应用传统流行病学的方法，结合环境与人群健康关系的特点，从宏观上研究外环境因素与人群健康关系的科学。它的研究必须考虑因果关系以及剂量-反应关系（C对ABDE错）的情况。